30岁男性，30分钟前被刀刺右前胸部，咳血痰，呼吸困难。体检：血压107/78mmHg，脉搏96次/分，右前胸有轻度皮下气肿，右锁骨中线4肋间可见3cm长创口，随呼吸有气体进出伤口响声。该患者半小时后收入病房，病人呼吸困难，轻度紫绀，右胸部皮下气肿明显加重，X线胸片示右肺完全萎陷，纵隔向左侧偏移，右侧平膈肌水平可见液平面。正规处理是
A. 立即输血
B. 准备行手术探查
C. 伤口清创并行胸腔闭式引流
D. 用注射器穿刺排气
E. 继续观察

正确答案：C。伤口清创并行胸腔闭式引流

解析：青年男性患者，右前胸部刀刺伤，可见创口，有气体进出响声，且右前胸有皮下气肿，结合患者病史和临床表现，考虑该患者为开放性气胸。患者入院后X线片示右肺完全压缩，纵隔左偏，右侧平膈肌水平可见液平面，说明患者气胸量加大、胸膜腔出血，提示患者存在血气胸。此时正规处理是及时行伤口清创、缝合胸壁伤口，并行胸腔闭式引流（C对），以促进肺复张。患者血压、脉搏尚稳定，暂无输血（A错）指征。开胸手术探查（B错）主要用于疑有胸腔内脏损伤或进行性血胸的患者。注射器穿刺排气（D错）主要用于张力性气胸的治疗。